患者，男，58岁。既往有高血压病史，晨起时突然出现口眼㖞斜，语言謇涩，右侧半身不遂，痰多，腹胀便秘，头晕目眩，舌质红，苔黄腻，脉弦滑，即来医院就诊，测血压180/100mmHg，头颅CT未见异常，其诊断是
A. 高血压病，肝阳暴亢，风火上扰证
B. 高血压病，脑梗死，风痰瘀血痹阻脉络证
C. 高血压病，脑出血，气虚血瘀证
D. 高血压病，脑梗死，痰热腑实，风痰上扰证
E. 高血压病，阴虚风动证

正确答案：D。高血压病，脑梗死，痰热腑实，风痰上扰证

解析：患者既往有高血压病史，故可诊断为高血压病；晨起突然出现口眼㖞斜，语言謇涩，右侧半身不遂，可考虑脑梗死的发生；痰热腑实，气机不利故痰多，腹胀便秘；风痰上扰清空故头晕目眩；舌质红，苔黄腻，脉弦滑均属于痰热腑实，风痰上扰所致（D对）。风火上扰证（A错）的特点为平素头晕头痛，耳鸣目眩，突然发生口眼歪斜，舌强语謇，或手足重滞，甚则半身不遂。风痰瘀血痹阻脉络证（B错）的特点为肌肤不仁，手足麻木，突然口眼歪斜，语言不利，口角流涎，舌强语謇，甚则半身不遂，或兼见手足拘挛。气虚血瘀证（C错）的特点为肢体不遂，软弱无力，形体肥胖，气短声低，面色萎黄，舌质淡暗或有瘀斑。阴虚风动证（E错）的特点为突然发生口眼歪斜，舌强语謇，半身不遂，平素头晕头痛，耳鸣目眩，腰膝酸软。